用薄层色谱法检查游离肼的药物是
A. 肾上腺素
B. 异烟肼
C. 盐酸四环素
D. 地西泮
E. 氟康唑

正确答案：B。异烟肼

解析：本题考查游离肼的限量检查。异烟肼（B对）用薄层色谱法检查游离肼。